水中毒的特征是
A. 组织间液增多
B. 血容量急剧增加
C. 细胞外液增多
D. 过多的低渗性液体滞留，造成细胞内液和细胞外液均增多
E. 过多的液体积聚于体腔

正确答案：D。过多的低渗性液体滞留，造成细胞内液和细胞外液均增多

解析：水中毒是由各种原因引起的机体水摄入过多或排出过少使机体体液量明显增多，体钠总量不变而出现过多的低渗性液体滞留，造成细胞内液和细胞外液均增多（D对）。组织间液增多（A错）、过多的液体积聚于体腔（E错）见于水肿。水中毒时有血容量增多（B错）、细胞外液增多（C错），但不是主要特征。